治疗类风湿关节炎
A. 抗CD3单克隆抗体
B. 抗肿瘤坏死因子抗体
C. β干扰素
D. α干扰素
E. EPO

正确答案：B。抗肿瘤坏死因子抗体

解析：免疫紊乱是类风湿关节炎的主要发病机制，活化的T细胞和MHC-Ⅱ型阳性的抗原提呈细胞浸润关节滑膜，启动特异性免疫应答。滑膜的巨噬细胞可因抗原而活化，使细胞因子如TNF-α、IL-1、IL-6、IL-8等增多，促使滑膜处于慢性炎症状态，此为类风湿关节炎的主要发病机制。因此治疗类风湿关节炎可阻断各种致炎因子的作用，常用抗肿瘤坏死因子（TNF-α）抗体（B对）。抗CD3单克隆抗体（A错）主要用于抗移植排斥反应。β干扰素（C错）为治疗多发性硬化症的一线药物。α干扰素（D错）具有抗病毒、抗肿瘤和免疫调节作用，常用于急、慢性肝炎的治疗。EPO（E错）能够促进红细胞生成，用于治疗贫血，尤其是肾性贫血。